非甾体抗炎药（NSAIDs）相关性溃疡病，在不能停用NSAIDs时，最好选用
A. 抗酸剂
B. 胶体铋剂
C. 抗菌药物
D. 质子泵抑制剂
E. 胃动力药

正确答案：D。质子泵抑制剂

解析：本题考查消化道溃疡的治疗。质子泵抑制剂（D对）即PPI，能达到快速治愈溃疡的目的。非甾体抗炎药会对胃黏膜造成损伤，若不能停用，可同时使用质子泵抑制剂来保护胃黏膜。抗酸剂（A错）是降低胃内酸度。胶体铋剂（B错）为胃黏膜保护类非处方药药品。抗菌药物（C错）指具有杀菌或抑菌活性的药物。胃动力药（E错）是能促进胃肠蠕动的药物。